B（a）P被机体吸收后可分布于全身，并可大量蓄积于
A. 肝脏
B. 胃
C. 脂肪组织
D. 血液
E. 骨骼

正确答案：C。脂肪组织

解析：本题考查B（a）P在体内的代谢。B（a）P被机体吸收后可分布于全身，并可大量蓄积于脂肪组织（C对ABDE错）。